眼睛辨认5m以上目标的视觉能力低于正常称为
A. 视力低下
B. 近视
C. 远视
D. 散光
E. 弱视

正确答案：B。近视